恒牙窝沟龋和上前牙的邻面龋的好发人群为
A. 婴幼儿
B. 青少年
C. 中年
D. 老年
E. 普遍发生

正确答案：B。青少年

解析：青少年多发生恒牙窝沟龋和上前牙的邻面龋。掌握“龋病的临床表现与分类”知识点。